主治风寒外束痰热内蕴之哮喘的方剂是
A. 止嗽散
B. 定喘汤
C. 麻杏石甘汤
D. 小青龙汤
E. 苏子降气汤

正确答案：B。定喘汤

解析：定喘汤方含麻黄（君）宣肺并散风寒，白果（君）敛肺，桑白皮（臣）泻肺；黄芩（臣）清热化痰；并佐以杏仁、苏子、半夏、款冬花，降气平喘，化痰止咳；佐使甘草，以止咳，调和诸药。共奏宣降肺气，清热化痰之功，主治风寒外束，痰热内蕴之哮喘（B对）。止嗽散功用为宣利肺气，疏风止咳，主治风邪犯肺之咳嗽证（A错）。麻杏石甘汤功用为辛凉疏表，清肺平喘，主治外感风邪，邪热壅肺证（C错）。小青龙汤功用为解表散寒，温肺化饮，主治外寒内饮证（D错）。苏子降气汤功用为降气平喘，祛痰止咳，主治上实下虚之喘咳证（E错）。